牙酸蚀症的预防方法有
A. 多吃水果
B. 嚼服酸性药物
C. 进食酸性食物
D. 拒绝口香糖
E. 减少喝碳酸饮料

正确答案：E。减少喝碳酸饮料

解析：本题考查牙酸蚀症的预防方法。牙酸蚀症的预防方法有减少喝碳酸饮料（E对）。牙酸蚀症的预防方法：1.加强口腔健康教育。2.治疗可引起牙酸蚀症的疾病。3.减少饮食中的酸对牙的侵蚀：减少酸性食物和饮料的摄入量及摄入频率，可用吸管饮用，减少酸性饮料接触牙面的时间；可在饮料中加入钙、磷离子，增加其饱和度，从而改变酸性饮料本身的性质，减弱其酸蚀性；对一些pH较低的药物则应尽量避免嚼服，如果不能避免应及时漱口。4.避免在酸性环境中与酸的接触。5.增强牙对酸的抵抗力：对于患有系统性疾病，需要长期服药而导致口干的患者，应尽早与相关的临床医师联系，考虑调整用药或采取其他保护措施；平时最好用含氟牙膏刷牙和含氟漱口水漱口，增强牙齿对酸的抵抗力。6.改变不良饮食习惯及口腔卫生习惯：酸性饮食的摄入最好安排在就餐时，此时唾液的流量大，缓冲能力强。不要安排在两餐之间，尤其不要在晚上睡觉前。餐后喝牛奶能在一定程度上中和食物中的酸。摄入酸性饮食后可用含氟漱口水漱口。刷牙时宜用含氟牙膏刷牙；选用刷毛软硬适度的牙刷，采用正确的刷牙方法及合适的力度刷牙均能预防牙酸蚀症。综上所述，多吃水果（A错）、嚼服酸性药物（B错）、进食酸性食物（C错）、拒绝口香糖（D错）均不是牙酸蚀症的预防方法。